可通过母婴传播的传染病是
A. 甲型病毒性肝炎
B. 艾滋病
C. 流行性脑脊髓膜炎
D. 霍乱
E. 细菌性痢疾

正确答案：B。艾滋病

解析：HIV通过过性传播（包括同性、异性和双性性接触）、体液传播（包括HIV污染的血液及血制品、乳汁等）和母婴传播（B对）（包括产前、产中和产后）三种途径传播；甲型病毒性肝炎（A错）主要经过粪-口途径传播；流行性脑脊髓膜炎（C错）主要通过咳嗽、喷嚏等飞沫由呼吸道直接传播；霍乱（D错）是消化道传染病，患者及带菌者的粪便或排泄物污染水源或食物后可引起霍乱的暴发流行；细菌性痢疾（E错）主要通过粪-口途径传播。